天麻入煎剂时
A. 另煎
B. 烊化后冲服
C. 不宜久煎
D. 与其他药同煎
E. 先煎

正确答案：D。与其他药同煎

解析：本题考查的是天麻的用法用量。天麻入煎剂时与其他药同煎（D对）。天麻：【用法用量】内服：煎汤，3～10g；研末，每次1～1.5g；也可入丸散。羚羊角：【用法用量】内服：煎汤，1～3g，宜另煎（A错）2小时以上，与煎好的药液合兑；磨汁或挫末，每次0.3～0.6g；也可入丸散。饴糖：【用法用量】内服：入汤剂，30～60g，分次烊化冲服（B错）；或入丸散。薄荷：【用法用量】内服：煎汤，2～10g；或入丸散；不宜久煎（C错），入汤剂当后下。外用：适量，鲜品捣敷或捣汁涂，也可煎汤洗或含漱。其叶长于发汗，梗偏于理气。石决明：【用法用量】内服：煎汤，6～20g，打碎先下（E错）；或入丸散。外用：适量，点眼。平肝清肝宜生用，点眼应煅后水飞用。